以易兴奋症和震颤为主要表现的职业中毒最可能是
A. 慢性铅中毒
B. 慢性汞中毒
C. 慢性苯中毒
D. 慢性三硝基甲苯中毒
E. 慢性一氧化碳中毒

正确答案：B。慢性汞中毒